颞下颌关节急性前脱位治疗
A. 医生站在患者的前方，双手拇指放置前牙切端复位
B. 医生站在患者的前方，双手拇指放置下颌牙齿的咬合面，缠以纱布向上前方向复位
C. 复位时患者坐在牙科椅上或坐在矮凳上，头依后墙，其下颌牙齿的咬合面要低于医生肘关节水平
D. 手术复位
E. 当髁状突复位后，已恢复正常咬合关系，无需固定，3周限制下颌运动

正确答案：C。复位时患者坐在牙科椅上或坐在矮凳上，头依后墙，其下颌牙齿的咬合面要低于医生肘关节水平

解析：本题考查颞下颌关节脱位。颞下颌关节急性前脱位治疗复位时患者坐在牙科椅上或坐在矮凳上，头依后墙，其下颌牙齿的咬合面要低于医生肘关节水平（C对）。颞下颌关节急性脱位后，应及时复位，常用口内法。复位后，为了使被牵拉过度受损的韧带、关节盘诸附着和关节囊得到修复，必须在复位后固定下颌2～3周，限制开颌运动；开口不宜超过1cm，对于复发性关节脱位患者，可采用关节囊内注射50%葡萄糖1～1.5mL，必要时可作重复性注射。注射后限制下颌运动1～2个月。如治疗无效，可以采用手术治疗，如关节镜外科手术、关节结节增高术、关节囊紧缩及关节结节凿平术等。对于陈旧性脱位则一般需手术复位治疗。